缓解偏头痛的首选药物是
A. 尼莫地平
B. 普萘洛尔
C. 丙戊酸钠
D. 阿米替林
E. 曲普坦

正确答案：E。曲普坦

解析：偏头痛的药物治疗分为发作期治疗和预防性治疗。预防性治疗药物包括β肾上腺素能受体阻滞剂（B错）、钙离子拮抗剂（A错）、抗癫痫药（C错）、抗抑郁药和5-HT受体拮抗剂（D错）。发作期治疗药物包括非甾体类抗炎药等非特异性药物和麦角类、曲普坦类（E对）等阿片类特异性药物。